肝郁乘脾可见
A. 肛门重坠
B. 大便时干时稀
C. 肛门灼热
D. 大便先干后稀
E. 便黑如柏油

正确答案：B。大便时干时稀

解析：若患者平素大便时干时稀，属肝郁脾虚，正常情况下，肝的疏泄有助于脾的运化，肝气郁结，疏泄失职，影响脾脏的运化，故见大便溏结不调。（B对）。肛门重坠（A错）见于脾虚气陷或大肠湿热等证。肛门灼热（C错）指排便时自觉肛门灼热的症状，多因大肠湿热，或热结旁流，热迫直肠所致。若大便先干后稀（D错）是脾虚，因脾虚运化失职故便溏，而大肠传导不畅则便结。便黑如柏油（E错）谓之远血，多见于胃脘等部位出血。